在水中不溶但可膨胀的是
A. 聚酰胺
B. 活性炭
C. 氧化铝
D. 微滤膜
E. 羟丙基葡聚糖凝胶

正确答案：E。羟丙基葡聚糖凝胶

解析：本题考查的是常见填料的性质。在水中不溶但可膨胀的是葡聚糖凝胶（E对）。凝胶色谱法：凝胶色谱法也称凝胶过滤法、凝胶渗透色谱法、分子筛过滤或排阻色谱，是根据物质分子大小差别进行分离。该法所用载体，如葡聚糖凝胶，是在水中不溶、但可膨胀的球形颗粒，具有三维空间的网状结构。聚酰胺（A错）为聚酰胺吸附色谱法的吸附剂。聚酰胺吸附属于氢键吸附，力量较弱，介于物理吸附与化学吸附之间，也称半化学吸附。聚酰胺对黄酮类、醌类等化合物之间的氢键吸附效果较好，特别适合分离酚类、醌类、黄酮类化合物。活性炭（B错）是非极性吸附剂，与硅胶、氧化铝相反，对非极性物质具有较强的亲和能力，在水中对溶质表现出强的吸附能力。氧化铝（C错）为吸附剂，分离原理都是根据吸附能力大小不同进行分离。另外，氧化铝又分为酸性或碱性氧化铝，如黄酮等酚酸性物质被碱性氧化铝的吸附，或生物碱被酸性氧化铝的吸附等，这又属于化学吸附。微滤膜（D错）为透析膜，用于透析法。对于生物大分子，一般可以通过透析法对其进行浓缩和精制。透析法是一种根据溶液中分子的大小和形态，在微米（μm）数量级下选择性过滤的技术。在常压下，选择性的使溶剂和小分子物质通过透析膜，大分子不能通过，以达到分离纯化的目的，从本质上讲它是一种溶液相的分子筛作用。